男，32岁。因十二指肠溃疡行BillrothⅡ式胃大部切除术后6个月。术后出现反酸、烧心症状。应用抑酸剂治疗无效。上述症状逐渐加重，并呕吐胆汁样物，上腹部及胸骨后烧灼样疼痛，体重减轻。查体：贫血貌，消瘦，营养不良，巩膜无黄染。胃液中无游离酸。胃镜检查见黏膜充血、水肿、糜烂。最适当的治疗措施是
A. 采用少食多餐方式
B. 行Roux-en-Y胃空肠吻合术
C. 长期应用消胆胺治疗
D. 注意餐后勿平卧
E. 应用H₂受体拮抗剂

正确答案：B。行Roux-en-Y胃空肠吻合术

解析：青年男性患者，因十二指肠溃疡行BillrothⅡ式胃大部切除术，术后6个月出现反酸、烧心，呕吐胆汁样物，抑酸剂治疗无效，胃液中无游离酸，胃镜检查见黏膜充血、水肿、糜烂（提示碱性反流性胃炎），结合患者病史、体查和相关检查，应诊断为碱性反流性胃炎。该患者症状较重，故最适当的治疗措施是行Roux–en–Y胃空肠吻合术（B对），以减少胆汁反流入胃的机会。采用少食多餐方式（A错）、应用H₂受体拮抗剂（E错）、注意餐后勿平卧（D错）、应用消胆胺（结合胆汁酸药物）（C错）等内科保守治疗适用于症状较轻的患者。